手术治疗后的道德要求，错误的表述是
A. 认真书写手术记录
B. 加强术后观察
C. 客观地介绍手术和非手术治疗的各种可能性
D. 防止各种并发症的发生
E. 若有异常情况发生，及时处理

正确答案：C。客观地介绍手术和非手术治疗的各种可能性